不属于药物经济学研究的服务对象是
A. 政府管理部门
B. 医疗服务供方
C. 医疗保险公司
D. 医生与患者
E. 药品检验机构

正确答案：E。药品检验机构